单侧舌下神经损害可出现的表现是
A. 单侧眼睑下垂
B. 单侧额纹消失
C. 单侧鼻唇沟浅
D. 单侧舌肌萎缩
E. 单侧角膜反射消失

正确答案：D。单侧舌肌萎缩

解析：单侧舌下神经损害可出现的表现是单侧舌肌萎缩（D对）。舌下神经损害表现：①核下性病变伸舌偏向病侧，伴同侧舌肌萎缩。双侧舌下神经麻痹时舌不能伸出口外，出现吞咽困难和构音障碍。②核性损害除上述核下性病变的表现外，还可见舌肌束颤。③一侧核上性损害伸舌偏向病灶对侧，舌肌萎缩或束颤。